类风湿关节炎常见的关节表现是
A. 对称性近端指间掌指和腕关节持续性肿痛
B. 膝髋和踝关节非对称，持续肿痛
C. 膝关节单侧或双侧肿痛，休息后好转
D. 单侧第一跖趾关节剧烈肿痛
E. 胸锁关节肿痛

正确答案：A。对称性近端指间掌指和腕关节持续性肿痛

解析：类风湿关节炎主要累及近端指间关节、掌指关节、腕、肘和肩关节等，常表现为对称性、持续性的肿胀和压痛（A对）。膝髋和踝关节非对称性持续肿痛（B错）为强直性脊柱炎的表现。膝关节单侧或双侧肿痛，休息后好转（C错）为膝关节骨关节炎的表现。单侧第一跖趾关节剧烈肿痛（D错）为痛风关节炎的典型表现。胸锁关节肿痛（E错）可见于胸锁关节炎。